男，71岁。乏力伴食欲不振半年，查体贫血貌，心肺腹部未见异常。化验血常规：WBC3.0×10⁹/L，Hb88g/L，Plt75×10⁹/L，MCV122fL，MCH34pg，Ret0.04。该患者最可能的诊断是
A. 缺铁性贫血
B. 慢性病性贫血
C. 脾功能亢进
D. 巨幼细胞贫血
E. 再生障碍性贫血

正确答案：D。巨幼细胞贫血

解析：男，71岁。乏力伴食欲不振半年（消化系统症状），查体贫血貌，心肺腹部未见异常。化验血常规：WBC3.0×10⁹/L（白细胞，正常值4-10×10⁹/L），Hb88g/L（血红蛋白，正常值120-160g/L），Plt75×10⁹/L，MCV122fL（红细胞平均体积，正常值80-100fl），MCH34pg（平均红细胞血红蛋白量，正常值27.0-34.0pg）表现为大细胞贫血，而巨幼细胞性贫血表现为大细胞贫血（D对）。缺铁性贫血（A错）、慢性病性贫血（B错）表现为小细胞低色素贫血。脾功能亢进（C错）、再生障碍性贫血（E错）表现为正细胞性贫血。